治疗应首选
A. 泻青丸
B. 温胆汤
C. 大定风珠
D. 清肝达郁汤
E. 十味温胆汤

正确答案：C。大定风珠

解析：该题考查多发性抽动症的辩证以及方药。多发性抽搐症临床特征为慢性、波动性、多发性运动肌快速抽搐，并伴有不自主发声和语言障碍。阴虚风动证以形体消瘦，两颧潮红，五心烦热，舌红绛，苔光剥，脉细数为特征。 该患儿，男，13岁。患儿挤眉眨眼，耸肩摇头，肢体震颤，口出秽语，夜热，手足心热，性情急躁，睡眠不宁，大便干结，舌红苔少，脉弦细而数。可判断为多发性抽动症阴虚风动，方药大定风珠加减（C对）。泻青丸清肝泻火，用于耳鸣耳聋，口苦头晕，两胁疼痛，小便赤涩（A错）。温胆汤理气化痰，和胃利胆，治疗胆郁痰扰证（B错）。清肝达郁汤治疗气郁化火，证候面红耳赤，烦躁易怒，皱眉眨眼，张口歪嘴，摇头耸肩，发作频繁，抽动有力，口出异声秽语，大便秘结，小便短赤，舌红苔黄，脉弦数，方药清肝达郁汤加减（D错）。十味温胆汤治疗脾虚痰聚，证候面黄体瘦，精神不振，胸闷作咳，喉中声响，皱眉眨眼，嘴角抽动，肢体动摇，脾气乖戾，夜睡不安，纳少厌食，舌质淡，苔白或腻，脉沉滑或沉缓，方药十味温胆汤加减（E错）。